男，70岁。上腹痛一年，进食后加重，大便10次/天，可见脂肪滴。查体：上腹中部压痛（+）。腹部B超：胰腺多发钙化灶。应给予的药物是
A. 钙通道阻滞剂
B. 质子泵抑制剂
C. 抗胆碱药物
D. 胰酶制剂
E. H₂受体拮抗剂

正确答案：D。胰酶制剂

解析：老年男性，上腹痛，进食后加重，大便10次/天，（慢性胰腺炎表现为反复发作性或持续性腹痛、腹泻或脂肪泻），可见脂肪滴（粪便检查发现脂肪滴是慢性胰腺炎的典型临床表现），查体：上腹中部压痛（+），B超示胰腺多发钙化灶。结合患者病史、体征、检查，考虑诊断为慢性胰腺炎，非手术治疗可给予大量外源性胰酶制剂（D对）。质子泵抑制剂（B错）或H₂受体拮抗剂（E错）为急性胰腺炎的非手术治疗用药。钙通道阻滞剂（A错）常用于高血压病、冠心病和心律失常，不用于慢性胰腺炎治疗。抗胆碱药物（C错）临床上用作散瞳药、制止分泌药和解痉止痛药等，慢性胰腺炎不宜使用。